苯妥英钠首选用于
A. 癫痫肌阵挛性发作
B. 癫痫大发作
C. 癫痫精神运动性发作
D. 癫痫小发作
E. 癫痫持续状态

正确答案：B。癫痫大发作